男婴10个月。近2个月出现面色黄，少笑不哭，智力发育倒退。查体发现四肢及头部颤抖，腱反射亢进，踝阵挛阳性。不符合该患儿诊断的指标是
A. 平均红细胞血红蛋白浓度34%
B. 幼红细胞胞浆发育落后于胞核
C. 网织红细胞减少
D. 平均红细胞血红蛋白量34pg
E. 平均红细胞容积106fl

正确答案：B。幼红细胞胞浆发育落后于胞核

解析：10月患儿，近月出现面色黄、少笑不哭、智力发育倒退、四肢及头部颤抖，腱反射亢进、踝阵挛阳性的临床症状，应诊断为营养不良性巨幼贫。营养不良性巨幼贫由于缺乏细胞核成熟需要的叶酸，使细胞核发育受限，从而出现幼红细胞胞浆发育先于胞核的现象（B错，为本题正确答案）。营养不良性巨幼贫的平均红细胞血红蛋白浓度在32%～38%（A对）。营养不良性巨幼贫的网织红细胞、白细胞、血小板计数常减少（C对）。营养不良性巨幼贫血象检查为MCV＞94fl（E对），MCH＞32pg（D对）。